《药品不良反应报告和管理办法》规定，药品不良反应报告的内容和统计资料是
A. 处理医疗纠纷、医疗诉讼的依据
B. 处理药品质量事故的依据
C. 处理医疗责任事故的依据
D. 加强药品监督管理，指导合理用药的依据
E. 加强药品监督管理，指导临床用药的依据

正确答案：D。加强药品监督管理，指导合理用药的依据

解析：本题考查药品不良反应报告和监测管理。《药品不良反应报告和监测管理办法》第五十七条：药品不良反应报告的内容和统计资料是加强药品监督管理、指导合理用药的依据（D对）。